应激时能增强机体对多种应激原的耐受能力
A. HSP70
B. 白蛋白
C. 急性期反应蛋白
D. 儿茶酚胺
E. β-内啡肽

正确答案：A。HSP70

解析：HSP70(A对)是HSP在应激时能增强机体对多种应激原的耐受能力。